男性，25岁，会阴区胀痛，尿频尿急，下腹痛，按压痛，无反跳痛，尿常规阴性。考虑诊断为
A. 慢性前列腺炎
B. 泌尿系结核
C. 膀胱炎
D. 肾癌
E. 膀胱结石

正确答案：A。慢性前列腺炎

解析：患者男性，25岁，会阴区胀痛，尿频尿急，下腹痛，按压痛，无反跳痛，尿常规阴性，结合患者的表现，考虑诊断为慢性前列腺炎（A对）。